青年李某，右下腹疼痛难忍，到医院就诊。经医师检查检验，当即诊断为急性阑尾炎，遂对其施行阑尾切除术。手术情况正常，但拆线时发现伤口愈合欠佳，有淡黄色液体渗出。手术医师告知，此系缝合切口的羊肠线不为李某人体组织吸收所致，在临床中少见。经过近1个月的继续治疗，李某获得痊愈。根据《医疗事故处理条例》规定，李某被拖延近1个月后才得以痊愈这一客观后果，应当属于
A. 二级医疗事故
B. 三级医疗事故
C. 四级医疗事故
D. 因患者体质特殊而发生的医疗意外
E. 因不可抗力而造成的不良后果

正确答案：D。因患者体质特殊而发生的医疗意外

解析：《医疗事故处理条例》规定了6种情形不属于医疗事故：①在紧急情况下为抢救垂危患者生命而采取紧急医学措施造成不良后果的；②在医疗活动中由于患者病情异常或者因患者体质特殊而发生医疗的意外；③在现有医学科学技术条件下，发生无法预料或者不能防范的不良后果的；④无过错输血感染造成不良后果的；⑤因患方原因延误诊疗导致不良后果的；⑥因不可抗力造成不良后果的。患者李某手术缝合切口的羊肠线不为其组织吸收，在临床中少见，导致伤口愈合所致，在临床中少见，导致李某被拖延近1个月后才得以痊愈的客观后果，属于因患者体质特殊而发生的医疗意外（D对），不属于医疗事故（ABC错）。不可抗力是指当事人不能预见和人力所不能抗御的强制力量，如台风、洪水、地震或战争等（E错）。